人类的生命和健康是上帝神灵所赐，疾病和灾祸是天谴神罚，是哪种医学模式指导下的认识
A. 神灵主义医学模式
B. 自然哲学的医学模式
C. 机械论的医学模式
D. 生物医学模式
E. 生物-心理-社会医学模式

正确答案：A。神灵主义医学模式